在神经-肌接头化学传递中，消除乙酰胆碱的酶是
A. 磷酸二酯酶
B. 腺苷酸环化酶
C. 胆碱酯酶
D. ATP酶
E. 单胺氧化酶

正确答案：C。胆碱酯酶